妊娠恶阻，口苦，呕吐酸水或苦水者，多为
A. 脾胃虚弱
B. 肝胃不和
C. 脾虚痰湿
D. 肝郁脾虚
E. 肝经湿热

正确答案：B。肝胃不和

解析：素体肝旺，孕后阴血聚下以养胎，肝血益虚，肝火更旺，且因冲气偏盛，冲气夹肝火上逆犯胃，胃失和降，遂致妊娠恶阻；肝胆互为表里，肝气上逆则胆火随之上升，胆热液泄，故口苦，呕吐酸水或苦水（B对）。妊娠恶阻脾胃虚弱证的临床表现是妊娠早期，恶心呕吐，甚则食入即吐，口淡，呕出物为清水或食物，头晕，神疲倦怠，嗜睡；舌淡，苔白，脉缓滑无力（A对）。